肝脏Glisson纤维鞘内包裹的管道有
A. 门静脉、肝静脉、肝胆管
B. 门静脉、肝动脉、胆总管
C. 门静脉、肝动脉、肝静脉
D. 门静脉、肝动脉、肝胆管
E. 肝静脉、肝胆管、肝动脉

正确答案：D。门静脉、肝动脉、肝胆管

解析：肝脏Glisson纤维鞘内包裹的管道有：门静脉、肝动脉、肝胆管（D对）。肝静脉、胆总管不包括在Glisson纤维鞘内（ABCE错）。